主要抑制排卵的避孕药作用机制是
A. 负反馈地抑制CRH的分泌，从而抑制FSH和LH的分泌
B. FSH下降使卵泡不能发育成熟
C. 促进子宫内膜的正常增殖
D. 可改变受精卵在输卵管内的运行速度，使其不能适时到达子宫
E. 能使腺体分泌不足宫颈黏液变稠，不利于精子通过

正确答案：A、B。负反馈地抑制CRH的分泌，从而抑制FSH和LH的分泌；FSH下降使卵泡不能发育成熟

解析：本题考查避孕药的作用机制。避孕药作用机制包括抑制排卵和干扰着床，主要抑制排卵的避孕药由孕激素和雌激素配伍，通过负反馈抑制下丘脑促性腺释放激素的分泌，从而抑制垂体前叶卵泡刺激素（FSH）和黄体生成素（LH）的分泌（A对）。FSH下降，使卵泡不能发育与成熟（B对）。